窦房结的动脉多发自
A. 右冠状动脉
B. 左冠状动脉
C. 右冠状动脉右缘支
D. 右冠状动脉圆锥支
E. 左冠状动脉旋支

正确答案：A。右冠状动脉

解析：右冠状动脉（A对）一般分布于窦房结、右房、右室前壁大部分、右室侧壁和后壁的全部，左室后壁的一部分和室间隔后1/3，包括左束支的后半以及房室结等部位。